既是吸气，又是呼气的肌是
A. 肋间外肌
B. 膈
C. 肋间内肌
D. 胸大肌
E. 前锯肌

正确答案：B。膈

解析：肋间外肌（A错）提肋助吸气。膈（B对）助呼吸（即既是吸气，又是呼气的肌）。肋间内肌（C错）降肋助呼气。胸大肌（D错）使肩关节内收、旋内和前屈。前锯肌（E错）拉肩胛骨向前并紧贴胸廓。